女，20岁，眼睑水肿3个月，尿常规：RBC：20-30/HP，尿蛋白（++），尿相差显微镜：可见棘球红细胞，血肌酐60umol/L，考虑疾病为
A. 肾小管疾病
B. 肾小球疾病
C. 肾静脉疾病
D. 肾动脉疾病
E. 肾间质疾病

正确答案：B。肾小球疾病

解析：女，20岁，眼睑水肿3个月，尿常规：RBC：20-30/HP，尿蛋白（++），尿相差显微镜：可见棘球红细胞(肾小球源性血尿)，血肌酐60umol/L，考虑为肾小球疾病（B对）。